酚妥拉明作用于其他药物无效的充血性心脏病时错误的是
A. 心脏后负荷明显降低
B. 左室舒张末压下降
C. 肺动脉压下降
D. 心输出量减少
E. 心力衰竭减轻

正确答案：D。心输出量减少

解析：治疗急性心肌梗死和顽固性充血性心力衰竭：可用酚妥拉明等血管扩张药治疗其他药物无效的急性心肌梗死及充血性心脏病所致的心力衰竭。因可扩张血管、降低外周阻力，使心脏后负荷明显降低、左室舒张末压与肺动脉压下降、心输出量增加，心力衰竭得以减轻。掌握“α肾上腺素受体阻断剂”知识点。